1克分子琥珀酸脱氢生成延胡索酸时，脱下的一对氢原子经过呼吸链氧化生成水，同时生成多少克分子ATP
A. 1.5
B. 2
C. 2.5
D. 3
E. 5

正确答案：A。1.5